流行病学研究方法之一的横断面调查也称
A. 病例-对照研究
B. 现况调查
C. 现场试验
D. 群组研究
E. 常规资料分析

正确答案：B。现况调查

解析：本题考查描述性流行病学-横断面研究。流行病学研究方法之一的横断面调查也称现况调查（B对）。流行病学研究方法包括描述性研究、分析性研究、流行病学实验。描述性研究是流行病学中最长用的一种，包括横断面研究、纵向研究和常规资料分析。横断面研究（横断面调查）也称现况调查，调查目标人群中某种疾病或现象在某一特定时点的情况。纵向研究也称疾病监测，即研究疾病或某种情况在一个人群中随着时间推移的自然动态变化。常规资料分析（E错）也称历史资料分析，即对已有的资料或者疾病监测记录做分析或总结。分析性研究包括病例-对照研究（A错）和群组研究（D错）。流行病学实验包括临床实验、现场试验（C错）、社区干预实验。